介于人与人之间的一种直接的面对面信息沟通的交流活动是
A. 人际传播
B. 互动传播
C. 直接传播
D. 双向传播
E. 单向传播

正确答案：A。人际传播